患者，男，50岁。咳嗽2个月，痰中带血，不发热，抗感染治疗效果不明显。3次X线检查均显示右肺中叶炎症。首先考虑的诊断是
A. 肺炎球菌肺炎
B. 肺结核
C. 肺癌
D. 支气管扩张
E. 病毒性肺炎

正确答案：C。肺癌

解析：患者中年男性，咳嗽、痰中带血（肺癌表现）、不发热，抗感染治疗效果不明显（说明不是肺部感染性疾病），且X线检查显示右肺中叶炎症，患者最可能的诊断为肺癌（C对），X线检查显示右肺中叶炎症是由于肿瘤造成的阻塞性肺炎。肺炎球菌肺炎（P46）（A错）表现为寒战、高热、痰中带血或呈铁锈色，抗感染治疗有效。肺结核（P64）（B错）表现为咳嗽、咳痰以及低热、盗汗、乏力等结核杆菌中毒症状。支气管扩张（P38）（D错）表现为咳嗽、咳痰及反复咯血。病毒性肺炎（P51）（E错）表现为干咳、发热、呼吸困难、紫绀和食欲减退，肺部体征较少。